男，60岁。剧烈胸痛2.5小时。心电图示II、Ⅲ、aVF、V5～V6导联ST段弓背向上抬高0.4mV，此时最可能升高的实验室检查指标是
A. 肌钙蛋白I
B. 天门冬氨酸氨基转移酶
C. 乳酸脱氢酶
D. 肌酸激酶同工酶
E. 肌红蛋白

正确答案：E。肌红蛋白

解析：中老年男性患者（急性心梗高发人群），剧烈胸痛2.5小时（急性心梗最先出现的症状）。心电图示II、I、aVF、V5～V6导联ST段弓背向上抬高0.4mV（急性ST段抬高型心梗的典型心电图表现）。根据患者的病史、症状和心电图检查，考虑诊断为STEMI。患者起病后2.5小时，最可能升高的实验室检查指标是肌红蛋白（E对）（起病后2小时内升高）。而肌钙蛋白I（A错）起病3～4小时后升高。肌酸激酶同工酶CK-MB（D错）升高，在起病后4小时内增高。另外，天冬氨酸氨基转移酶（AST）（B错）以及乳酸脱氢酶（LDH）（C错），其特异性及敏感性均远不如上述心肌坏死标志物，已不再用于诊断AMI。